男，32岁，后背及双上臂沸水烫伤4小时，查体：T37.4℃，P100次/分，R20次/分，BP130/90mmHg，意识清楚，后背及双上臂背侧红肿明显，大量水疱，基底发红，疼痛明显。该患者皮肤烧成的深度和分度
A. 浅Ⅱº中度烧伤
B. 深Ⅱº轻度烧伤
C. 深Ⅱº重度烧伤
D. 浅Ⅱº轻度烧伤
E. 深Ⅱº中度烧伤

正确答案：A。浅Ⅱº中度烧伤

解析：该患者后背及双上臂背侧被沸水烫伤（烫伤面积16.5%），烫伤后出现后背及双上臂背侧红肿明显，大量水疱，基底发红，疼痛明显，可判定烧伤程度达到了浅Ⅱº烧伤，据中度烧伤的定义：Ⅱº烧伤面积11%~30%，或有Ⅲ°烧伤但面积不足10%可知，此患者为中度烧伤，所以该患者烧伤的深度和分度为浅Ⅱº中度烧伤（A对）。